导致小儿营养性缺铁性贫血的主要原因是
A. 铁摄入量不足
B. 先天储铁不足
C. 铁吸收障碍
D. 生长发育快
E. 铁的丢失过多

正确答案：A。铁摄入量不足

解析：本题考查营养性缺铁性贫血的主要原因。小儿营养性缺铁性贫血的主要原因是未及时添加富含铁的食物，导致铁摄入量不足（A对BCDE错）。